患者，女，32岁，已婚。婚后4年未孕，月经3~5月一行，经量甚少，形体肥胖，头晕心悸，带下量多、质稠，面色晄白，舌苔白腻，脉滑。治疗应首选
A. 温胆汤
B. 二陈汤
C. 过期饮
D. 调经助孕丸
E. 启宫丸

正确答案：E。启宫丸

解析：患者婚后4年未孕，平素月经3~5月一行，经量甚少，且形体肥胖，胖人多虚，脾肾虚水湿停聚，聚而成痰，阻滞冲任胞宫，气机不畅，经行退后或停闭；痰阻冲任，脂膜壅塞，遮隔子宫，不能摄精成孕而不孕；带下量多，质稠，面色晄白，舌苔白腻，脉滑是为水湿内停，痰湿内阻之证。故治疗选择启宫丸以燥湿化痰，行滞调经（E对）。温胆汤功效理气化痰，和胃利胆，治疗胆郁痰扰证，常见胆怯易惊，头眩心悸，心烦不眠，夜多异梦；或呕恶呃逆，眩晕，癫痫。苔白腻，脉弦滑（A错）。二陈汤功效燥湿化痰，理气和中，治疗湿痰证，常见咳嗽痰多，色白易咯，恶心呕吐，胸膈痞闷，肢体困重，或头眩心悸，舌苔白滑或腻，脉滑（B错）。过期饮主治血虚气滞，经水过期不行（C错）。调经助孕丸温肾健脾，活血调经，用于脾肾阳虚，瘀血阻滞所致的月经不调，闭经，痛经，不孕；症见月经后错，经水量少，有血块，行经小腹冷痛，经水日久不行，久不受孕，腰膝冷痛（D错）。七版教材痰湿内阻证，方用苍附导痰丸。